以零级速率释放药物的经皮吸收制剂的类型是
A. 多储库型
B. 微储库型
C. 黏胶分散型
D. 微孔骨架型
E. 聚合物骨架型

正确答案：A。多储库型